军团菌进入人体的主要途径是
A. 呼吸道
B. 消化道
C. 皮肤
D. 消化道和呼吸道
E. 皮肤和消化道

正确答案：A。呼吸道

解析：本题考查军团菌进入人体的主要途径。军团菌进入人体的主要途径是人通过呼吸道（A对BCDE错）吸入被军团菌污染的气溶胶，使军团菌有机会侵染肺泡组织和肺巨噬细胞，引起严重的肺部感染，从而导致军团病的发生。